长期使用第一类精神药品的癌症患者，一般应多久进行复诊
A. 每一周
B. 每半个月
C. 每3个月
D. 每4个月
E. 每5个月

正确答案：C。每3个月

解析：医疗机构应当要求长期使用麻醉药品和第一类精神药品的门（急）诊癌症患者和中、重度慢性疼痛患者，每3个月复诊或者随诊一次。掌握“处方的开具、监督管理及法律责任”知识点。